男，32岁。反复皮肤紫癜1个月，加重并腹痛2天。查体：四肢皮肤散在紫癜，心肺未见异常，腹平软，脐周轻压痛，无反跳痛和肌紧张，肝脾肋下未触及，肠鸣音6次/分。临床诊断为过敏性紫癜。根据目前的临床资料，首选考虑最可能的临床类型是
A. 单纯型
B. 肾型
C. 混合型
D. Schonlein型
E. Henoch型

正确答案：E。Henoch型

解析：过敏性紫癜包括单纯型（紫癜型）、腹型（Henoch型）、关节型（Schonlein型）、肾型和混合型。该患者除有四肢皮肤散在紫癜外，还有腹痛和脐周轻压痛等腹部症状。临床诊断为过敏性紫癜，最有可能的临床类型是腹型，即Henoch型（E对）。单纯型（A错）过敏性紫癜主要表现为成批反复发生、对称分布的皮肤紫癜，局限于四肢，尤其是下肢及臀部，躯干极少累及，可同时伴发皮肤水肿、荨麻疹；肾型（B错）过敏性紫癜病情最为严重，常在皮肤紫癜的基础上，出现血尿、蛋白尿及管型尿，偶见水肿、高血压及肾衰竭等表现；关节型（Schonlein型）（D错）过敏性紫癜除皮肤紫癜外，常有膝、踝、肘、腕等大关节处的关节肿胀、疼痛、压痛及功能障碍等表现；混合型（C错）常表现为皮肤紫癜合并上述两种以上临床表现。